男，28岁，间歇性上腹痛3年，饥饿时，夜间易发作，进餐后缓解。根据该病的发病机制，影响该症状的主要因素是
A. 胃酸
B. 胃蛋白酶原
C. 组胺
D. 粘液
E. 促胃液素

正确答案：A。胃酸

解析：该患者男，28岁，间歇性上腹痛3年，饥饿时，夜间易发作，进餐后缓解（十二指肠溃疡的疼痛特点），结合患者的表现，考虑为十二指肠溃疡，所以影响该症状的主要因素是胃酸（A对B错）。组胺可分泌盐酸（C错）。粘液屏障可以起到包括胃黏膜的作用（D错）。促胃液素也是可引起消化性溃疡（E错）。